适合婴儿使用的牙刷是
A. 电动牙刷
B. 指套牙刷
C. 单束毛牙刷
D. 小插刷
E. 丝柄刷

正确答案：B。指套牙刷

解析：6个月到2岁为乳牙萌出阶段，基本是父母给孩子刷牙，可以从指套型牙刷开始进行口腔清洁。掌握“自我口腔保健方法”知识点。